人工流产手术中
A. 易引起DIC
B. 易引起失血性休克
C. 易引起颈管粘连
D. 易引起迷走神经综合征
E. 最易致肠管损伤

正确答案：D。易引起迷走神经综合征

解析：在施行人工流产手术中，有少数妇女出现恶心、呕吐、头晕、胸闷、气喘、面色苍白、大汗淋漓、四肢厥冷、血压下降，心律不齐等，严重者还可能出现晕厥、抽搐、休克等一系列症状，医学上将其称之为“人流综合征”即迷走神经综合征。掌握“自然流产”知识点。